当胃中等充盈时，胃的前壁在剑突下有未被肋弓遮掩的部分,可直接接触下列的结构是
A. 膈
B. 肝右叶
C. 肝左叶
D. 腹前壁
E. 胰

正确答案：D。腹前壁

解析：胃中等充盈时，左侧与膈相邻(A错)，右侧与肝左叶和方叶相邻(BC错)，在剑突下，部分胃前壁直接接触腹前壁(D对)，为临床胃触诊的部位，后壁与胰(E错)相邻。